某男，69岁。患骨质疏松症，症见腰脊疼痛、足膝酸软、乏力。医师处以仙灵骨葆胶囊，此成药的使用注意事项是
A. 孕妇禁用。肝功能失代偿者禁用
B. 因含制附片而不宜长期服用
C. 服药后不宜立即饮茶
D. 疮疡肿痛者慎用
E. 脾胃虚弱者慎用

正确答案：A。孕妇禁用。肝功能失代偿者禁用

解析：本题考查的是仙灵骨葆胶囊的注意事项。某男，69岁。患骨质疏松症，症见腰脊疼痛、足膝酸软、乏力。医师处以仙灵骨葆胶囊，此成药的使用注意事项是孕妇禁用。肝功能失代偿者禁用（A对）。仙灵骨葆胶囊：【注意事项】孕妇禁用。肝功能失代偿者禁用。对本品过敏者禁用。过敏体质、湿热痹者慎用。高血压、心脏病、糖尿病、肝病、肾病等慢性病严重者慎用。感冒时不宜服用。服药期间，忌食生冷、油腻食物。痛风定胶囊：【注意事项】孕妇慎用。风寒湿痹者慎用。因含土茯苓，故服药后不宜立即饮茶（C错）。服药期间，宜食清淡食品，忌食肉类、鱼虾、豆类、辛辣之品，忌饮酒。小活络丸：【注意事项】所含制川乌、制草乌有大毒，故孕妇禁用，不可过量服用或久服。湿热瘀阻或阴虚有热者、脾胃虚弱者慎用（E错）。据报道，有服用本品引起心律失常、药疹、急性胃黏膜出血的不良反应，使用时应引起注意。